完整的乳牙（牙合）时期应是
A. 2.5至4岁左右
B. 2.5至6岁左右
C. 4～6岁期间
D. 6～8岁期间
E. 6～12岁期间

正确答案：B。2.5至6岁左右

解析：完整的乳牙（牙合）约在2岁半时建成，并形成稳定的乳牙（牙合）关系。从2岁半至6岁左右第一颗恒牙萌出之前，皆属乳牙（牙合）时期。掌握“（牙合）的生长发育”知识点。